社会环境对人类健康的影响日益受到重视，它相对于自然环境又被称为
A. 机体外环境
B. 机体内环境
C. 物质环境
D. 非物质环境
E. 其它

正确答案：D。非物质环境